细菌性痢疾肠道病变最显著的部位是在
A. 升结肠
B. 横结肠
C. 降结肠
D. 乙状结肠
E. 乙状结肠和直肠

正确答案：E。乙状结肠和直肠

解析：急性细菌性痢疾病变最显著的部位是大肠，以直肠与乙状结肠（E对）为主，重者可以波及整个结肠和回肠末端。菌痢的典型临床表现为腹泻+里急后重，里急后重即直肠刺激症状，而直肠刺激症状多发生于直肠。